按五行属性分类，五化中属土者是
A. 生
B. 长
C. 化
D. 收
E. 藏

正确答案：C。化

解析：五行属性中，木具有生长、升发、舒畅、条达的特性，春属木，春天万物复苏，生机勃勃，故生属木（A错）。火具有温热、向上、光明的特性，夏属火，夏天阳光充足，雨露滋润，万物快速生长，故长属火（B错）。土具有生化、承载、受纳的特性，长夏属土，长夏万物经过夏天的迅猛生长，结出果实，并且果实向成熟转化，故化属土（C对）。金具有清肃、收敛的特性，秋属金，秋天万物凋零，与春天的生机勃勃相比，生机收敛，果实也到了收获的季节，故收属金（D错）。水具有滋润、下行、闭藏的特性，冬属水，冬天大部分植物树叶落光，有些动物也进入冬眠，万物如藏起来一样，故藏属水（E错）。